某男，30岁，患头痛半年，血压偏高，证属肝阳头痛。近日因食麻辣烫与大量花生而引发头部生疮，红肿热痛，宜选用的药是
A. 菊花
B. 西河柳
C. 牛蒡子
D. 升麻
E. 赤芍

正确答案：A。菊花

解析：本题考查的是菊花的主治病证。患头痛半年，血压偏高，证属肝阳头痛。近日因食麻辣烫与大量花生而引发头部生疮，红肿热痛，宜选用的药是菊花（A对）。菊花：【主治病证】（1）风热感冒，温病初起。（2）风热或肝火上攻所致的目赤肿痛。（3）肝阴虚之眼目昏花。（4）风热头痛，肝阳头痛、眩晕。（5）热毒疮肿。西河柳（B错）：【主治病证】（1）麻疹透发不畅，风疹瘙痒。（2）风湿痹痛。牛蒡子（C错）：【主治病证】（1）风热感冒，温病初起。（2）风热或肺热咳嗽、咯痰不畅，咽喉肿痛。（3）麻疹不透，风热疹痒。（4）热毒疮肿，痄腮。升麻（D错）：【主治病证】（1）风热头痛，麻疹透发不畅。（2）热毒疮肿，丹毒，痄腮，咽喉肿痛，口舌生疮，温毒发斑。（3）气虚下陷之久泻脱肛、崩漏下血及胃下垂、子宫脱垂等。赤芍（E错）：【主治病证】（1）温病热入营血之斑疹吐衄，火热内伤之血热吐衄，皮下出血。（2）血滞之闭经、痛经，产后瘀阻，癥瘕，跌打肿痛。（3）痈肿疮毒，目赤肿痛，肝郁化火之胁痛。